人类结核病的主要病原菌是
A. 牛型结核菌
B. 鼠型结核菌
C. 人型和鼠型结核菌
D. 人型和牛型结核菌
E. 猪型结核菌

正确答案：D。人型和牛型结核菌

解析：本题考查人类结核病的主要病原菌。结核病的病原体为结核杆菌，属分枝杆菌，主要包括结核分枝杆菌、牛分枝杆菌，非洲型分枝杆菌和田鼠分枝杆菌。人类结核病的主要病原菌是人型和牛型结核菌（D对ABCE错）。